髁突、关节盘相对移位时，其弹响性质是
A. 开口初或闭口末单声弹响
B. 开口末或闭口初单声弹响
C. 连续摩擦音
D. 多声破碎音
E. 爆裂音

正确答案：A。开口初或闭口末单声弹响

解析：本题考查髁突、关节盘相对移位时弹响的性质。关节盘移位的机制是关节盘向前移位，在作开口运动时，髁突横嵴撞击关节盘后带的后缘时，迅速向前下继而向前上运动，同时关节盘向后反跳，从而髁突由关节盘后带的后缘到达关节盘中间带的下面，恢复正常的髁突-关节盘的结构关系，此短暂的过程发生开口初期的弹响（A对），当关节盘迁移程度加重时，可发生开口中期及开口末期的弹响（B错）。在骨关节病骨、软骨面粗糙可出现连续摩擦音（C错）。关节盘穿孔、破碎或移位可出现多声破碎音（D错）。爆裂音（E错）见于肺部疾病如肺炎、肺结核、肺气肿， 不属于髁突、关节盘相对移位时的弹响性质。